某患者，60岁。右下6因松动于三个月前拔除，要求修复。若设计塑料基托，基托的厚度是
A. 1mm
B. 2mm
C. 3mm
D. 大于4mm
E. 越薄越好

正确答案：B。2mm

解析：本题考查局部义齿的设计。塑料基托一般不少于1.5-2mm（B对），过薄易折，过厚易引起患者不适。